患儿，3个月出生体重2500g，近日夜寐不安，汗出较多为预防维生素缺乏性佝偻病，每日需补充的维生素D剂量是
A. 100IU
B. 400IU
C. 600IU
D. 800IU
E. 1200IU

正确答案：B。400IU

解析：患儿近日夜寐不安，汗出较多为预防维生素缺乏性佝偻病，每日需补充的维生素D剂量是400IU，每日预防剂量，<1 岁改为400IU（B对）。